患者，女，40岁。发现颈部肿块2天，查体：气管右侧可扪及一结节，质硬，表面不光滑，可随吞咽上下移动，同侧胸锁乳突肌前缘可扪及2个肿大淋巴结。应首先考虑的中医诊断是
A. 气瘿
B. 瘿痈
C. 瘿瘤
D. 肉瘿
E. 石瘿

正确答案：E。石瘿

解析：本题患者，女，40岁发现颈部肿块2天，查体：气管右侧可扪及一结节，质硬，表面不光滑，可随吞咽上下移动，同侧胸锁乳突肌前缘可扪及2个肿大淋巴结应首先考虑的中医诊断是石瘿（E对）。单纯性甲状腺肿又称地方性甲状腺肿，碘的缺乏是引起单纯性甲状腺肿的主要原因。青春期、妊娠期和绝经期由于甲状腺素的需要量增高，也可发生轻度弥漫性甲状腺肿，称为生理性甲状腺肿。此病女性多见，发病年龄以10～30岁为高峰期。本病相当于中医的“气瘿”（A错）。甲状腺炎分急性化胺性甲状腺炎、亚急性用甲状腺炎和慢性淋巴细胞性甲状腺炎三类，其中急性化脓性甲状腺炎临床少见。甲状腺炎属中医“瘿痈”的范畴，一般有感染症状（B错）。甲状腺腺瘤是最常见的甲状腺良性肿瘤。本病多发生于40岁以下的妇女。临床特点是颈前无痛性肿块，多为单发，质地柔韧，光滑，边界清楚，随吞咽动作上下移动，生长缓慢。本病属中医“肉瘿”范畴（D错）。纤维瘤由纤维结缔组织构成，可见于任何年龄和部位，属中医“肉瘤”范畴（C错）。